患者，男，15岁。最近出现视物不清，且逐渐加重，全身皮肤干燥，脱屑。该患者可能缺乏
A. 钙
B. 维生素A
C. 核黄素
D. 维生素PP
E. 维生素C

正确答案：B。维生素A

解析：维生素A缺乏可导致暗适应能力下降，结膜干燥角化可形成眼干燥症，严重可致失明；题中患者出现视物不清，且逐渐加重，符合这一症状。维生素A缺乏还可引起皮肤干燥，题中患者全身皮肤干燥，脱屑，同样符合（B对）。钙（A错）缺乏可引起骨骼病变，如儿童佝偻病、成人骨质软化及老年人骨质疏松症。维生素B₂（核黄素）（C错）缺乏可出现口角炎、眼睑缘炎和阴囊皮炎。烟酸（维生素PP）（D错）缺乏可引起皮炎、舌炎、肠炎、精神异常及周围神经炎等疾病。维生素C（E错）缺乏可引起坏血病，临床症状为牙龈肿胀出血、结膜出血和关节疼痛等。